阿托品属于
A. 胆碱酯酶抑制药
B. M受体阻断药
C. α、β受体激动药
D. α受体阻断药
E. β受体阻断药

正确答案：B。M受体阻断药

解析：本题考查阿托品。阿托品是M受体阻断药（B对），可以麻痹睫状肌，用于眼科手术前的散瞳及青少年屈光检查。胆碱酯酶抑制药（A错）有多奈哌齐、利斯的明等。α 、β受体激动药（C错）有肾上腺素。α受体阻断剂（D错）有酚妥拉明、哌唑嗪等。β受体阻断药（E错）有普萘洛尔。